口腔颌面部发育中唯一发生融合的部位
A. 侧腭突和鼻中隔未融合或部分融合
B. 两侧腭突融合并与向下生长的鼻中隔融合
C. 一侧或两侧的球状突与上颌突未联合或部分联合
D. 前腭突与上颌突未能联合或部分联合
E. 两侧下颌突未联合或部分联合

正确答案：B。两侧腭突融合并与向下生长的鼻中隔融合

解析：左右侧腭突在中缝处自前向后逐渐融合，并与向下生长的鼻中隔发生融合。这是口腔颌面部发育中唯一发生融合的部位。侧腭突的融合，形成硬腭之大部分、软腭和悬雍垂约在胚胎第3个月，腭部发育完成，口腔与鼻腔完全隔开。掌握“腭部与舌的发育”知识点。